应用曲妥珠单抗治疗乳腺癌前对患者必须进行基因筛查，筛查的项目是
A. 表皮生长因子受体
B. 血管内皮生长因子
C. B淋巴细胞表面的CD₂O抗原
D. 人表皮生长因子受体-2
E. 雌激素受体

正确答案：D。人表皮生长因子受体-2

解析：本题考查曲妥珠的使用。应用曲妥珠单抗治疗乳腺癌前对患者必须进行基因筛查，筛查的项目是人表皮生长因子受体-2（D对）。西妥昔单抗单用或与伊立替康联合用于表皮生长因子受体（A错）过度表达。贝伐单抗作用于血管内皮生长因子（B错）。利妥昔单抗治疗淋巴瘤时应筛查B淋巴细胞表面的CD₂O抗体（C错）。